细菌性阴道病以抗厌氧菌治疗为主，不宜选用的药物是
A. 甲硝唑
B. 多西环素
C. 替硝唑
D. 克林霉素
E. 奥硝唑

正确答案：B。多西环素

解析：本题考查细菌性阴道病的药物治疗。细菌性阴道病的药物治疗不包括多西环素（B错，为本题正确答案）。细菌性阴道炎全身用药首选甲硝唑（A对）400mg，口服，每日2次，连用7日。其次为替硝唑（C对）2g，口服，每日1次，连用3日；或替硝唑1g，口服，每日1次，连用5日。或克林霉素（D对）300mg，口服，每日2次，连用7日。局部用药甲硝唑阴道栓（片）200mg，阴道用药，每晚1次，连用7日；或2%克林霉素软膏5g，阴道用药，每晚1次，连用7日。哺乳期以选择局部用药为宜。奥硝唑（E对）与甲硝唑、替硝唑同样作为硝基咪唑类抗菌药物对厌氧菌也具有较好的治疗作用。